关于酶活性中心的叙述，正确的是
A. 酶原有能发挥催化作用的活性中心
B. 由一级结构上相互邻近的氨基酸组成
C. 必需基团存在的唯一部位
D. 均由亲水氨基酸组成
E. 含结合基团和催化基团

正确答案：E。含结合基团和催化基团

解析：酶原激活的实质是酶的活性中心形成或暴露，酶原本身没有能发挥催化作用的活性中心（A错）。酶活性中心的裂缝或凹陷结构多是由疏水氨基酸形成的（D错）。酶分子中有的必需基团位于酶的活性中心内，其有结合基团和催化基团（E对）之分；有的必需基团位于酶的活性之外（C错）。这些必需基团在一级结构上可能相距较远，但在空间结构上相互接近（B错）。